男，35岁。反复发热、头痛伴消瘦3个月。查体：颈抵抗（＋），双侧克氏征（—）。实验室检查：结核感染T细胞检测（＋），脑脊液抗酸染色（+）。胸部CT示双肺多发斑点，小结节影（双上肺为著）。给予异烟肼、利福平、吡嗪酰胺、乙胺丁醇四联治疗。若患者长期应用上述四联治疗，最可能缺乏的维生素是
A. 维生素B2
B. 维生素B12
C. 维生素B1
D. 维生素B6
E. 维生素C

正确答案：D。维生素B6

解析：患者肺结核，给予异烟肼、利福平、吡嗪酰胺、乙胺丁醇四联治疗。异烟肼神经系统常见不良反应为周围神经炎，表现为手脚麻木、肌肉震颤和步态不稳等。大剂量可出现头痛、头晕、兴奋和视神经炎，严重时可导致中毒性脑病和精神病。此作用是由于异烟肼的结构与维生素B6相似，使维生素B6排泄增加而致体内缺乏所致。因此长期应用异烟肼，会造成维生素B6（D对）缺乏。